与地方性氟骨症的发生无关的因素是
A. 妇女生育、授乳
B. 性别
C. 饮水含氟量
D. 年龄
E. 营养不良

正确答案：B。性别

解析：本题考查与地方性氟骨症的发生无关的因素。地方性氟骨症是指地方性氟中毒病区的居民，因摄入过量氟化物而引起以颈、腰和四肢大关节疼痛，肢体运动功能障碍以及骨和关节X射线征象异常为主要表现的慢性代谢性骨病。与其发生相关的因素有：1.年龄（D对）：氟骨症发病主要在成年人，发生率随着年龄增长而升高，且病情严重；2.妇女生育、授乳（A对）：由于生育、授乳等因素的影响，女性的病情往往较重，特别是易发生骨质疏松软化；3.居住时间：在病区居住年限越长，氟骨症患病率越高，病情越重；4.饮水含氟量（C对）：在饮水含氟量低于1mg/L情况下也有氟中毒发生；5.营养不良（E对）：在暴露相同氟浓度条件下，经济发达、营养状况好的地区氟中毒患病率低，病情较轻。相反，营养状况不佳的地区患病率高，病情较重。地方性氟骨症的发生一般与性别（B错，为本题正确答案）无关。